蛋白质的消化酶主要来源于
A. 胃
B. 小肠
C. 胆囊
D. 胰腺
E. 肝脏

正确答案：D。胰腺

解析：胃蛋白酶只是初步消化，而蛋白质的主要消化来源于胰腺分泌的胰蛋白酶。掌握“蛋白质生理作用及消化”知识点。